某女，25岁。月经延迟，小腹胀痛拒按经血量少，血色紫暗有块，经行不畅，经前胸胁、乳房胀痛，饮食可，二便调，舌暗，苔白，脉弦。根据中医诊法理论与实践，本病例所见小腹胀痛，经前胸胁、乳房胀痛的病机分析是
A. 气虚
B. 气滞
C. 血虚
D. 血瘀
E. 气逆

正确答案：B。气滞

解析：本题考查的是气滞证的临床表现。月经延迟，小腹胀痛拒按经血量少，血色紫暗有块，经行不畅，经前胸胁、乳房胀痛，饮食可，二便调，舌暗，苔白，脉弦。根据中医诊法理论与实践，本病例所见小腹胀痛，经前胸胁、乳房胀痛的病机分析是气滞（B对）。气滞证的临床表现，常见胀闷疼痛，妇女乳房胀痛。气虚（A错）证的临床表现，常见头晕目眩，少气懒言，疲倦乏力，自汗，活动时诸症加剧，舌淡，脉虚无力。血虚（C错）证的临床表现，常见面色苍白或萎黄，唇色淡白，头晕眼花，心悸失眠，手足发麻，妇女经行量少、愆期甚或经闭，舌质淡，脉细无力。血瘀（D错）证的临床表现，常见局部肿胀疼痛，痛如针刺，拒按，痛处固定不移，且常在夜间加重，一般伴有面色晦暗、口唇色紫、舌有瘀斑、口干但欲漱水不欲咽等症状。气逆（E错）证的临床表现及辨证要点：气逆证的临床表现，肺气上逆可见咳嗽喘息；胃气上逆，则见呃逆、嗳气、恶心呕吐；肝气升发太过，则见头痛、眩晕、昏厥、呕血等症。一般以气机上逆的症状为辨证要点。